某老师组织同学就“吸烟是否为个人行为”问题进行小组讨论。以下为讨论会的具体步骤，你认为存在问题的一项是
A. 分组，确定小组主持人和记录员，都由学生担任
B. 规定讨论时间
C. 老师积极引导，保持良好的讨论气氛
D. 每个小组推举代表向全班汇报
E. 老师进行总结，统一观点，对存在明显错误的一方强制压服

正确答案：E。老师进行总结，统一观点，对存在明显错误的一方强制压服